女，30岁。因慢性皮肤溃疡迁延不愈需接受高压氧治疗。患者对高压氧舱的封闭环境感到十分恐惧。心理医生与患者进行了充分的沟通，在做好各种应急准备之后，让患者直接进入髙压氧舱以快速克服恐惧心理。同时完成高压氧治疗。这种心理治疗方法是
A. 放松训练
B. 冲击疗法
C. 厌恶疗法
D. 系统脱敏法
E. 认知疗法

正确答案：B。冲击疗法

解析：患者对高压氧舱的封闭环境感到十分恐惧。心理医生与患者进行了充分的沟通，在做好各种应急准备之后，让患者直接进入髙压氧舱以快速克服恐惧心理。让病人一下子面对最高等级惧怕的情况，甚至过分地与惧怕的情况接触，为冲击疗法（B对）。放松训练（A错）是让病人坐在沙发上或藤椅上，双臂放于扶手，随意采取舒适的姿势。厌恶疗法（C错）是一种通过轻微的惩罚来消除适应不良行为的治疗方法。系统脱敏法（D错）是以社交恐惧症为例。由引起最低紧张等级的刺激开始脱敏。认知疗法（E错）主要目标是协助当事人克服认知的盲点，模糊的知觉，自我欺骗，不正确的判断，以及改变认知中对现实的直接扭曲或不合逻辑的思考方式（E错）。